下颌骨体部骨折固定时间应为
A. 1～2周
B. 2～3周
C. 4～6周
D. 7～8周
E. 9～10周

正确答案：C。4～6周

解析：本题考查下颌骨体部骨折的固定时间。颌骨骨折后应进行复位固定，以利于颌骨骨折处正确愈合。骨折复位固定的标准是恢复伤员原有的咬合关系，一般下颌骨固定时间为4～6周（C对），上颌骨固定3～4周。